6岁女孩主诉新牙歪斜。查：两上中切牙萌出2/3，向远中倾斜，中间2mm间隙。下列哪项是错误的
A. 侧切牙牙胚挤压中切牙牙根形成间隙
B. 多生牙，牙瘤的存在导致间隙
C. 唇系带附着过低形成间隙
D. 侧切牙先天缺失使中切牙出现间隙
E. 吮指习惯可使前牙出现间隙

正确答案：E。吮指习惯可使前牙出现间隙

解析：本题考查口腔不良习惯-吮指。吮指可能导致上前牙前突形成深覆盖、局部开（牙合），远中错（牙合），妨碍鼻腔发育，但不会造成中切牙间隙（E错，为本题的正确答案）。上颌左右中切牙之间在萌出早期出现间隙，可能是由于侧切牙牙胚萌出挤压中切牙牙根（A对）、多生牙和缺失牙（BD对）、唇系带附着过低（C对）。